治疗消渴时，属肾阴亏虚者，宜选用的中成药是
A. 补肾强身片
B. 杞菊地黄丸
C. 金芪降糖片
D. 消渴平片
E. 参苓白术丸

正确答案：B。杞菊地黄丸

解析：本题考查的是消渴的辨证论治。治疗消渴时，属肾阴亏虚者，宜选用的中成药是杞菊地黄丸（B对）。消渴是以多饮、多食、多尿、乏力、消瘦，或尿有甜味为主要临床表现的疾病。消渴之肾阴亏虚证【中成药应用】常用中成药有六味地黄丸（水蜜丸）、麦味地黄丸（水蜜丸）、杞菊地黄丸。消渴之气阴两虚证【中成药应用】常用中成药有参精止渴丸、参芪降糖胶囊、消渴丸。消渴之阴阳两虚证【中成药应用】常用中成药有金匮肾气丸。补肾强身丸（A错）具有阴阳双补作用，男性不育症临床上可酌情选用。补肾强身丸【功能】补肾强身。【主治】用于腰酸足软，头晕耳鸣，眼花心悸。消渴之阴虚燥热证【中成药应用】常用中成药有降糖胶囊、消渴平片（D错）、消糖灵胶囊。消渴之脾胃气虚证【中成药应用】常用中成药有参苓白术散（E错）、益津降糖口服液。